用于过敏性休克抢救的首选药物是
A. 多巴胺
B. 肾上腺素
C. 间羟胺
D. 去甲肾上腺素
E. 异丙肾上腺素

正确答案：B。肾上腺素

解析：肾上腺素激动α受体，收缩小动脉和毛细血管，消除黏膜水肿；激动β受体，改善心功能，升高血压，缓解支气管痉挛，减少过敏介质释放，可迅速缓解过敏性休克的临床症状，是治疗过敏性休克的首选药（B对）。